阴维脉阳维脉主要的功能有
A. 调节阳经气血
B. 调节阴经气血
C. 调节十二经气血
D. 维系全身阴阳经脉
E. 司眼睑之开合

正确答案：D。维系全身阴阳经脉

解析：该题主要考察奇经八脉的功能。阳维脉调节阳经气血（A错）阴维脉调节阴经气血（B错）；阴维脉和阳维脉的功能是维系调节全身阴阳经脉气血（D对）。冲脉的生理功能为调节十二经气血（C错），阴跷脉阳跷脉的生理功能为司眼睑之开合（E错）。